组织学上，恶性者所占比例最高的是
A. 白斑
B. 红斑
C. 溃疡
D. 糜烂
E. 扁平苔藓

正确答案：B。红斑

解析：口腔黏膜的红斑虽然不如白斑多见，但在组织学上其恶性者所占的比例却非常高。掌握“口腔白斑、红斑病”知识点。